脊髓半侧因肿瘤或外伤引起损伤，可产生
A. 同侧损伤节段以下弛缓性瘫痪，运动觉和位置觉障碍，对侧损伤节段以下痛温觉减退
B. 同侧损伤节段以下痉挛性瘫痪，触觉、运动觉和位置觉障碍，对侧损伤节段以下痛温觉丧失
C. 同侧损伤节段以下痉挛性瘫痪，触觉完好，运动觉和位置觉障碍，对侧损伤节段以下痛温觉丧失或减退
D. 运动、感觉均无明显受影响
E. 同侧损伤节段以下运动障碍，运动觉、触觉障碍，对侧仅损伤节段部分痛温觉丧失

正确答案：C。同侧损伤节段以下痉挛性瘫痪，触觉完好，运动觉和位置觉障碍，对侧损伤节段以下痛温觉丧失或减退

解析：脊髓中含有内侧丘系，传导肢体的运动和感觉，脊髓半侧因肿瘤或外伤引起损伤表现为：损伤平面以下，同侧肢体痉挛性瘫痪，位置觉、震动觉和精细触觉丧失，损伤节段下1-2个节段平面以下的对侧痛、温觉丧失（C对）。